男，68岁，2周来反复胸痛，发作与劳累及情绪有关，休息可以缓解。3小时前出现持续性疼痛，进行性加剧，并气促，不能平卧，血压110/70mmHg，心率120次/分，律齐，心尖部可闻及Ⅲ级收缩期杂音，双肺散在哮鸣音及湿性啰音，根据上述临床表现，该病人的诊断最可能是
A. 风心病二尖瓣关闭不全
B. 扩张型心肌病
C. 支气管哮喘
D. 支气管肺炎
E. 急性心肌梗死并发左心衰竭

正确答案：E。急性心肌梗死并发左心衰竭

解析：患者老年男性，反复发作胸痛，且与劳累及情绪有关，休息可以缓解，提示为心绞痛（急性心肌梗死常见前驱症状）。3小时前出现持续性疼痛，进行性加剧，心尖部可闻及Ⅲ级收缩期杂音（可由心肌缺血导致的乳头肌功能失调或断裂引起二尖瓣脱垂后产生），提示患者已发展为急性心肌梗死。患者气促，不能平卧，双肺散在哮鸣音及湿性啰音，考虑为急性左心衰竭。综上所诉，该病人的诊断最可能是急性心肌梗死并发左心衰竭（E对）。风心病二尖瓣关闭不全（A错）通常起病缓慢，从罹患风湿热至出现二尖瓣关闭不全的症状一般超过20年（P292），与本例不符。扩张型心肌病（P262）（B错）通常起病隐匿，可出现夜间阵发性呼吸性困难和端坐呼吸等左心功能不全症状，但不会发病如此迅速。支气管哮喘（P29）（C错）一般见于青年患者，多有过敏原接触史，典型症状为发作性伴有哮鸣音的呼气性呼吸困难，一般不会出现持续性胸痛。支气管肺炎（P42）（D错）以肺部症状为主，常见症状为咳嗽、咳痰，可出现脓性痰或血痰，多伴有发热症状，不会出现心力衰竭的症状。